男，6岁，身高80cm，智能落后，仅能数1～20个数。体检：皮肤粗糙，眼距宽，鼻梁宽平，舌宽厚，常伸于口外，毛发枯干，发际低，骨龄摄片仅有4枚骨化核。患儿确诊后治疗应选用
A. 低苯丙氨酸饮食
B. 甲状腺素
C. 生长激素
D. 低铜饮食
E. 脑活素脑复康

正确答案：B。甲状腺素

解析：先天性甲状腺功能减退的患儿一旦确诊，应终身服用甲状腺制剂（B对）。低苯丙氨酸饮食主要用于治疗苯丙酮尿症（P158）（A错）。生长激素主要用于治疗侏儒症（C错）。低铜饮食主要用于治疗肝豆状核变性（P160）（D错）。脑活素脑复康主要用于治疗儿童发育迟缓（E错）。